对照组发病率比实验组发病率称为
A. 相对危险度
B. 比值比
C. 率比
D. 保护指数
E. 效果指数

正确答案：E。效果指数

解析：本题考查效果指数的公式。效果指数（E对ABCD错）是评价预防措施效果的主要指标，其公式为：效果指数＝对照组发病（或死亡）率/实验组发病（或死亡）率。